抗感染和清除循环免疫复合物的重要方式是
A. 免疫黏附
B. 炎症介导
C. 调理吞噬
D. 经典途径
E. 膜攻击复合物的生物学作用

正确答案：A。免疫黏附

解析：免疫黏附：细菌等颗粒性抗原或免疫复合物在被C3b/C4b结合后可与表达补体受体的红细胞或血小板结合形成聚合物。这种聚合物易被吞噬细胞清除，这种现象被称为免疫黏附。免疫黏附是抗感染和清除循环免疫复合物的重要方式。掌握“补体功能及其与疾病的关系”知识点。